危险因素对健康的影响取决于
A. 危险强度
B. 危险频度
C. 危险程度
D. A、B和C
E. B和C

正确答案：D。A、B和C